疏松组织的弥漫性化脓性炎症属于
A. 肉芽肿
B. 浆液性炎
C. 卡他性炎
D. 蜂窝织炎
E. 纤维素性炎

正确答案：D。蜂窝织炎

解析：疏松组织的弥漫性化脓性炎症属于蜂窝织炎（D对）。肉芽肿（A错）是指炎症局部巨噬细胞及其衍生细胞增生形成的境界清楚的结节状病灶，是肉芽肿性炎（P78）的特征。浆液性炎（P75）（B错）是以浆液渗出为特征的炎症，卡他性炎（C错）是指发生于黏膜的浆液性炎。纤维素性炎（P75）（E错）是以渗出物中含有大量纤维素为特征的炎症。